软胶囊水溶性基质有
A. 蜂蜡
B. 聚乙二醇
C. 地蜡
D. 甲基纤维素
E. 白凡士林

正确答案：B、D。聚乙二醇；甲基纤维素

解析：本题考查软胶囊水溶性基质。聚乙二醇（B对）属于水溶性基质；甲基纤维素（D对）属于纤维素衍生物类水溶性基质；蜂蜡（A错）、地蜡（C错）、凡士林（E错）均属于油相基质。